引起食物中毒性白细胞缺乏症的病原物质是
A. 黄曲霉毒素
B. T-2毒素
C. 岛青霉素
D. 丁烯酸内酯
E. 脱氧雪腐镰刀菌烯醇

正确答案：B。T-2毒素

解析：本题考查引起食物中毒性白细胞缺乏症的病原物质。T-2毒素（B对ACDE错）是食物中毒性白细胞缺乏症的病原物质，主要破坏分裂迅速、增殖活跃的组织器官，导致多系统多器官的损伤。